患者腹大胀满，按之如囊裹水，伴下肢浮肿，胸脘痞胀，得热则舒，怯寒懒动，尿少便溏，舌苔白腻，脉缓。治疗应选
A. 实脾饮
B. 柴胡疏肝散
C. 附子理苓汤
D. 调营饮
E. 连朴饮

正确答案：A。实脾饮

解析：患者腹大胀满，按之如囊裹水可诊断为鼓胀。湿邪困遏，脾阳不振，寒水内停故腹大胀满，按之如囊裹水；寒水相搏，中阳不运故胸脘痞胀，精神困倦，怯寒懒动，尿少便溏。故为水湿困脾证，治宜温中健脾，行气利水，方选实脾饮（A对）。柴胡疏肝散功效疏肝解郁，行气止痛，主治肝气郁滞证（B错）。附子理苓汤温补脾肾，化气利水，可用于治疗鼓胀脾肾阳虚证（C错）。调营饮活血化瘀，行气利水，可用于治疗鼓胀肝脾血瘀证（D错）。连朴饮功效清热化湿，理气和中，主治湿热霍乱（E错）。